流行性斑疹伤寒的传播媒介是
A. 人虱
B. 鼠蚤
C. 恙螨
D. 蜱
E. 蚊

正确答案：A。人虱

解析：流行性斑疹伤寒的传播媒介是人虱（A对）。鼠蚤（B错）是莫氏立克次体引起的地方性斑疹伤寒的传播媒介（P134）。恙螨（C错）是恙虫病的主要传播媒介（P141）。蜱（D错）是人无形体病的主要传播媒介（P145）。蚊（E错）是由乙脑病毒引起的流行性乙型脑炎的传播媒介（P86）。